下列不是艾滋病的传播途径的是
A. 性传播
B. 母婴垂直传播
C. 血液传播
D. 虫媒传播
E. 日常生活接触传播

正确答案：D、E。虫媒传播；日常生活接触传播

解析：本题考查艾滋病的传播途径。艾滋病的主要传播途径包括：①性行为传播（A对）；②母婴传播（B对）；③血液传播（C对）。虫媒传播（D错，为本题正确答案）、日常生活接触传播（E错，为本题正确答案）不是艾滋病的传播途径。